假性神经递质引起肝性脑病的机制是
A. 干扰脑的能量代谢
B. 使脑细胞产生抑制性突出后电位
C. 干扰脑细胞膜的功能
D. 与正常递质竞争受体，但其效应远较正常递质弱
E. 促进血浆氨基酸失衡

正确答案：D。与正常递质竞争受体，但其效应远较正常递质弱

解析：肝功能严重障碍时，假性神经递质增多，可取代去甲肾上腺素和多巴胺被神经元摄取，并贮存在突触小体的埏泡中。但其被释放后的生理效应则远较去甲肾上腺素和多巴胺弱，脑干网状结构上行激动系统的唤醒功能不能维持，从而发生昏迷。（D对）